治疗甲状腺功能亢进症可选用的药物是
A. 甲巯咪唑
B. 二甲双胍
C. 米非司酮
D. 甲状腺激素
E. 甲苯磺丁脲

正确答案：A。甲巯咪唑

解析：本题考查甲硫咪唑。治疗甲状腺功能亢进症可选用的药物是甲巯咪唑（A对）。常用的治疗甲亢的药物：1.硫脲类，如甲硫氧嘧啶、丙硫氧嘧啶、甲巯咪唑、卡比马唑等。2.碘及碘化物，如复方碘溶液、碘化钾、碘化钠等。3.放射性碘。4.β受体拮抗剂，如普萘洛尔、美托洛尔、阿替洛尔等。二甲双胍（B错）为双胍类降糖药。米非司酮（C错）为女用避孕药。甲状腺激素（D错）用于治疗甲状腺功能减退症。甲苯磺丁脲（E错）为磺脲类口服降血糖药。